明确提出根据疾病性质和临床需要选择药物剂型的著作是
A. 黄帝经
B. 神农本草经
C. 伤寒论
D. 肘后备急方
E. 本草经集注

正确答案：D。肘后备急方

解析：本题考查中药常用古文献典籍。明确提出根据疾病性质和临床需要选择药物剂型的著作是《肘后备急方（D对）》。《肘后备急方》又名《肘后救卒方》，简称《肘后方》，全书总结了东晋以前的中医急症治疗成就，许多记载具有很高的医学史料价值，在急症的病因、病理上时有发明。《黄帝内经（A错）》又称《内经》，是最早的一部中医典籍，也是中医学最重要的经典著作。《黄帝内经》分《黄帝内经素问》和《灵枢经》两部分。《神农本草经（B错）》简称《本经》《本草经》《神农本草》。托名神农氏撰，约成书于东汉时期（公元25～219年），非一时一人所作。该书是最早的本草学专著，具有重要的科学价值和历史影响，为我国医药学四大经典着作之一。《伤寒论（C错）》简称《伤寒》，“六经辨证体系”继承了《内经》中关于经络、脏腑、气化、气血、营卫，以及邪正斗争、阴阳消长等理论，赋予“六经”以新的内容，奠定了中医学辨证论治的基础，对临床各科均有指导意义。《本草经集注（E错）》南朝·陶弘景（一作宏景，字通明，号华阳居士、华阳隐居、华阳真人）撰。成书于南北朝南齐永元二年（公元500年）之前。